社区卫生服务要求社区医生应掌握各级各类医疗机构和专家的各种情况，并与之建立相对固定的联系，这体现了其什么特点
A. 持续性服务
B. 协调性服务
C. 首诊医疗服务
D. 综合性服务
E. 人性化服务

正确答案：B。协调性服务

解析：本题考查社区卫生服务的特点。社区卫生服务有协调性与团队合作式服务（B对ACDE错）的特点，即作为健康代理人，一旦病人需要，以全科医生为核心的社区卫生服务提供者将协调医疗保健资源及社会力量，组织多学科的医疗保健团队，为病入提供医疗、护理、康复、精神、心理等多方面的综合服务；并通过会诊、转诊和会谈等措施，与上级医疗卫生机构、专科医生和病人家庭等方面协同解决病人的问题，从而确保其获得正确、有效、高质量的卫生服务。